在医院健康教育中，不属于心理卫生教育内容的是
A. 对待疾病的正确心理教育
B. 患者家属的心理教育
C. 临终关怀及死亡教育
D. 疾病预防、治疗知识的宜传教育
E. 指导家属给患者精神安慰

正确答案：D。疾病预防、治疗知识的宜传教育